生物医学研究伦理审查的监督管理内容除外
A. 伦理委员会是否建立伦理审查制定
B. 伦理审查内容和程序是否符合要求
C. 伦理审查结果执行情况
D. 伦理审查文档管理情况
E. 对受试者的研究中可能承担的风险是否有预防和应对措施

正确答案：E。对受试者的研究中可能承担的风险是否有预防和应对措施

解析：生物医学研究伦理审查的主要监督检查以下内容：1）医疗卫生机构是否按照要求设立伦理委员会，并进行备案。2）伦理委员会是否建立伦理审查制度。3）伦理审查内容和程序是否符合要求。4）审查的研究项目是否如实在我国医学研究登记备案信息系统进行登记。5）伦理审查结果执行情况。6）伦理审查文档管理情况。7）伦理委员会委员的伦理培训、学习情况。8）对国家和省级医学伦理专家委员会提出的改进意见或者建议是否落实。9）其他需要监督检查的相关内容。掌握“医学伦理委员会及医学伦理审查”知识点。